某地级市卫生行政部门接到举报，称市中心医院妇产科主治医师陶某违反《母婴保健法》及其实施办法相关规定，未经市级卫生行政部门批准擅自从事母婴保健专项技术服务，经查证举报属实，依法给予陶某行政处罚。陶某的违法行为是
A. 擅自开展宫腔镜手术
B. 擅自从事助产技术服务
C. 擅自开展孕妇营养咨询和指导
D. 擅自开展婴儿保健
E. 擅自从事婚前医学检查

正确答案：E。擅自从事婚前医学检查

解析：根据《母婴保健法》规定，擅自从事婚前医学检查、遗传病诊断、产前诊断、终止妊娠手术和医学技术鉴定或者出具有关医学证明为违法行为，结合选项，陶某是因擅自从事婚前医学检查违法的（E对）。